赵某，女，3岁。4天前高烧，2天前退烧，但继发口腔溃疡2天，啼哭，流延，拒食。体检发现患儿全口牙龈红肿，上腭黏膜可见丛集成簇的针头大小透明水疱，部分已破溃为表浅溃疡，广泛。本病例最可能的诊断为疱疹性龈口炎。本病例感染的病原体可能为
A. 柯萨奇病毒
B. 白色念珠集菌
C. 肺炎链球菌
D. 金黄色葡萄球菌
E. 单纯疱疹Ⅰ型病毒

正确答案：E。单纯疱疹Ⅰ型病毒

解析：本题考查疱疹性龈口炎的致病菌。疱疹性龈口炎的致病菌为单纯疱疹Ⅰ型病毒（E对）。柯萨奇病毒（A错）可引起疱疹性咽峡炎和手－足－口病。白色念珠集菌（B错）感染可引起鹅口疮。肺炎链球菌（C错）可引起肺炎链球菌性肺炎。金黄色葡萄球菌（D错）可引起球菌性口炎。